患者，女，55岁，因“反复发作，胸骨后疼痛2年，伴反酸、胃灼热。诊断为积食”就诊。食管测压提示食管下括约肌（LES）压力<6mmHg，结合胃镜检查结果，临床诊断为胃食管反流病。医师处方奥美拉唑肠溶片20mg，bid强化抑酸治疗。胃食管反流病的治疗应注意调整生活方式。关于对病例患者调整生活方式的说法，错误的是
A. 戒烟酒
B. 餐中多饮水
C. 控制体重
D. 避免高脂饮食
E. 抬高床头

正确答案：B。餐中多饮水

解析：本题考查胃食管反流病。该患者患有胃食管反流病，日常需控制体重（C对），避免饱餐和餐中饮水及睡前3小时内进食。每餐8分饱，可在两餐之间加餐（B错，为本题正确答案）。减少脂肪摄入（D对）。戒烟戒酒（A对）。餐后散步，不要立即平卧，夜间反流严重者可头侧、床脚各加高10～20cm（E对）。